当余留牙倾斜超过30°时不宜选作固定桥的基牙，主要因为
A. 受力后基牙的倾斜度加大
B. 桥体易弯曲变形
C. 不能承担（牙合）力
D. （牙合）力不能通过基牙的长轴传导
E. 磨去牙体组织太多

正确答案：D。（牙合）力不能通过基牙的长轴传导

解析：本题考查基牙的选择。当余留牙倾斜度超过30°时不宜选作固定桥的基牙主要是因为牙齿倾斜时，（牙合）力的方向并不会随着牙的倾斜而改变角度，牙长轴与（牙合）力的方向会产生一个角度，（牙合）力就不能沿牙长轴传导（D对），这样，该牙的牙周膜面积尽管没有减少，但能承受（牙合）力的牙周膜面积已减小，可能将无法满足固定桥对基牙的要求，使牙周组织受到创伤。当选择倾斜度超过30°的余留牙选作固定桥的基牙时，基牙会受到侧向力，但因为存在固定桥，基牙的倾斜度不会改变（A错），若基牙长期受此不正常（牙合）力，基牙会损伤，修复体可能会松动脱落。影响桥体弯曲变形的因素有桥体的厚度和长度、固定桥支架材料的机械强度、桥体的结构形态与牙合力的大小，基牙的倾斜度不能导致桥体弯曲变形，故桥体弯曲变形（B错）不是选择基牙时需要考虑的原因。当选择的基牙倾斜超过30°时，能承担（牙合）力的牙周膜面积减小，即基牙能承担的（牙合）力减小，并不是不能承担（牙合）力（C错）。当选择倾斜度超过30°的余留牙作为基牙（E错）时，为取得共同的就位道，的确需磨除较多的牙体组织，但这不是不作基牙的的主要原因。